石斛的功效有
A. 明目
B. 化瘀止血
C. 润肺止咳
D. 养胃生津
E. 滋阴除热

正确答案：A、D、E。明目；养胃生津；滋阴除热

解析：本题考查的是石斛的功效。斛的功效有明目（A对）、养胃生津（D对）与滋阴除热（E对）。石斛：【功效】养胃生津，滋阴除热，明目，强腰。白及：【功效】收敛止血（B错），消肿生肌。蜂蜜：【功效】补中缓急，润肺止咳（C错），滑肠通便，解毒。